下列哪项措施不利于增加人造冠的摩擦力
A. 备牙时增大聚合角度
B. 接触面适当粗糙
C. 人造冠与患牙紧密结合
D. 尽量使冠的各轴面平行
E. 点角、线角要清楚

正确答案：A。备牙时增大聚合角度

解析：本题考查增加人造冠摩擦力的措施。备牙时增大聚合角度（A错，为本题的正确答案）不利于增加人造冠的摩擦力。1.摩擦力的大小与两物体间所受的正压力成正比：正压力越大，摩擦力也越大。因此，两接触面接触越紧密，接触点间压强越大，摩擦力也越大。所以要求牙体缺损修复体与预备后的患牙紧密贴合（C对）。2.摩擦力的大小与两接触物体材料的性质及表面粗糙程度有关：表面较粗糙时，其摩擦力亦较大。摩擦系数大的物体，产生的摩擦力亦大。规范的牙体预备能产生适当的粗糙表面（B对），没有必要刻意粗糙牙表面，否则给精确印模的制取和蜡型的制作带来困难。3.牙体预备的几何形态和面积也是影响固位力大小的重要因素。理论上，预备的牙面互相平行才能获得最大的固位力（D对），因为轴壁越接近平行，修复体与轴壁越密贴，则受到的约束就越严格，脱位力的方向就常与轴壁间形成一定的角度，产生摩擦力的机会就越多。点角、线角清楚（E对）可增加人造冠的摩擦力。